半夏厚朴汤中，体现“治痰不理脾胃非其治也”的药物是
A. 半夏
B. 厚朴
C. 茯苓
D. 生姜
E. 苏叶

正确答案：C。茯苓

解析：虽然痰饮的生成与肺的宣肃通调、肾的蒸化水液，以及三焦津液的通道等功能失常有关，但脾不健运是重要的一环，故临床治疗痰饮当时时注意调理脾胃，除其生痰之源。脾为生痰之源，肺为伫痰之器，茯苓渗湿健脾，以助半夏化痰（C对）。半夏为君药辛温入肺胃，化痰散结，降逆和胃（A错）。厚朴下气除满，助半夏散结降逆（B错）。生姜为佐药辛温散结，和胃止呕，且制半夏之毒（D对）。苏叶芳香行气，理肺舒肝，助厚朴行气宽胸，宣通郁结之气（E错）。